可用于鉴别马钱子碱的反应是
A. 在酸水中通人 Cl2，溶液变为樱红色
B. Vitali反应呈阳性
C. 过碘酸氧化，乙酰丙酮缩合反应呈阳性
D. 加浓硝酸即呈深红色，继加氯化亚锡溶液即由红色转为紫色
E. 加 CuS04一 NaOH试剂呈蓝紫色

正确答案：D。加浓硝酸即呈深红色，继加氯化亚锡溶液即由红色转为紫色